Ⅱ型超敏反应导致的疾病是
A. 青霉素过敏性休克
B. 新生儿溶血病
C. 接触性皮炎
D. 食物过敏性腹泻
E. 花粉过敏性哮喘

正确答案：B。新生儿溶血病

解析：II型超敏反应临床常见疾病主要包括输血反应、新生儿溶血症（B对）、自身免疫性溶血性贫血、药物过敏性血细胞减少症、肺出血-肾炎综合征。青霉素过敏性休克（A错）、花粉过敏性哮喘（E错）、食物过敏性腹泻（D错）属于I型超敏反应。接触性皮炎（C错）属于Ⅳ型超敏反应。